盐炙的药物是
A. 当归
B. 车前子
C. 淫羊藿
D. 厚朴
E. 川乌

正确答案：B。车前子